男，78岁，1天前凌晨醒来发现失语伴右上肢活动无力进行性加重，但意识清楚，脑脊液检查无异常。最可能的诊断是
A. 蛛网膜下腔出血
B. 脑出血
C. 脑栓塞
D. 短暂性脑缺血发作
E. 脑血栓形成

正确答案：E。脑血栓形成

解析：本例患者老年男性，1天前凌晨醒来发现失语伴右上肢活动无力进行性加重，但意识清晰，脑脊液检查无异常，考虑诊断为脑血栓形成（E对）。脑血栓形成多见于中老年，常在安静或睡眠中发病，部分病例有肢体麻木、无力等前驱症状，局灶性体征多在发病后10余小时或1-2日达到高峰，患者一般意识清楚，脑脊液无异常。蛛网膜下腔出血（A错）以中青年发病居多，多在剧烈运动、情绪激动等情况下突然起病，有剧烈头痛、呕吐以及典型的脑膜刺激征，且脑脊液为均匀一致血性（P194）。脑出血（B错）多在情绪激动或活动中突然发病，多无前驱症状，脑脊液多表现为血性（P189）。脑栓塞（C错）多在活动中急骤发病，无前驱症状，多表现为完全性卒中，且有栓子来源病史（P185）。短暂性脑缺血发作（D错）发病突然，症状持续时间一般仅数分钟到数小时，过后完全正常，无后遗症状（P173）。